内痔的主要症状是
A. 便秘，疼痛
B. 便血，有分泌物
C. 便血，脱出
D. 便血，肛门痒
E. 便血，异物感

正确答案：C。便血，脱出

解析：内痔临床以便血，脱出（C对）为主要表现。肛门疼痛，便血，便秘是肛裂的主要表现（A错）。内痔痔核增大，脱出时可有异物感（E错）；痔核反复脱出，肛门括约肌松弛，常有分泌物溢于肛门外（B错）；分泌物长期刺激肛周皮肤，易发湿疹，瘙痒不适（D错）。